男，49岁。既往体健，因头晕半天，黑便3次，急诊。血压80/50mmHg，心率124次/分，面色苍白，冷汗。首先考虑
A. 急性肠炎
B. 急性胃穿孔
C. 心绞痛
D. 心肌梗塞
E. 食管下段癌出血

正确答案：E。食管下段癌出血

解析：中年患者，黑便（上消化道出血），心律124次/分、血压80/50mmHg、面色苍白、冷汗（失血性休克），根据临床表现，首先考虑为食管下段癌出血（P275）（E对）。食管下段癌时，可因进食食物等原因致癌肿破裂造成失血，进而可出现黑便、失血性休克等表现。急性出血性肠炎（A错）主要表现为急性的腹痛、腹胀、呕吐、腹泻等，而不会出现黑便等上消化道出血的表现。急性胃穿孔（P340）（B错）的典型表现为病人突发上腹剧痛，呈“刀割样”，腹痛迅速波及全腹，腹膜刺激征象明显。心绞痛（C错）及心肌梗塞（D错）患者主要表现为发病时心前区疼痛等。